经碱水加热可生成无酯键的醇胺型水解产物的生物碱是
A. 药根碱
B. 次乌头碱
C. 东莨菪碱
D. 莨菪碱
E. 甲基伪麻黄碱

正确答案：B。次乌头碱

解析：本题考查的是川乌中主要毒性生物碱在炮制过程中的变化。经碱水加热可生成无酯键的醇胺型水解产物的生物碱是次乌头碱（B对）。川乌中主要毒性生物碱及其化学结构：乌头和附子主要含二萜类生物碱，属于四环或五环二萜类衍生物。乌头生物碱的结构复杂、结构类型多。其重要和含量较高的有乌头碱、次乌头碱和新乌头碱。《中国药典》以三者为指标成分进行含量测定，要求三者总量应为0.050～0.17%。由于C₁₄和C₈的羟基常和乙酸、苯甲酸结合成酯，故称它们为二萜双酯型生物碱。川乌中主要毒性生物碱在炮制过程中的变化：乌头碱、次乌头碱、新乌头碱等为双酯型生物碱，具麻辣味，毒性极强，是乌头的主要毒性成分。若将双酯型生物碱在碱水中加热，或将乌头直接浸泡于水中加热，或不加热仅在水中长时间浸泡，都可水解酯基，生成单酯型生物碱或无酯键的醇胺型生物碱。如乌头碱水解后生成的单酯型生物碱为乌头次碱，无酯键的醇胺型生物碱为乌头原碱。单酯型生物碱的毒性小于双酯型生物碱，而醇胺型生物碱几乎无毒性，但它们均不减低原双酯型生物碱的疗效。这就是乌头及附子经水浸、加热等炮制后毒性变小的化学原理。药根碱（A错）为黄连的主要化学成分，属于季铵型生物碱。黄连的有效成分主要是生物碱，已经分离出来的生物碱有小檗碱（含量最高）、巴马汀、黄连碱、甲基黄连碱、药根碱和木兰碱（属于阿朴菲型）等；大多属苄基异喹啉类衍生物，季铵型生物碱。《中国药典》以小檗碱为指标成分进行含量测定。以盐酸小檗碱计，要求味连含小檗碱不得少于5.5%，表小檗碱不得少于0.80%，黄连碱不得少于1.6%，巴马汀不得少于1.5%；要求雅连含小檗碱不得少于4.5%；要求云连含小檗碱不得少于7.0%。东莨菪碱（C错）与莨菪碱（D错）为洋金花的主要化学成分，属于莨菪烷类生物碱。洋金花主要化学成分为莨菪烷类生物碱，由莨菪醇类和芳香族有机酸结合生成的一元酯类化合物。主要有莨菪碱（阿托品）、山莨菪碱、东莨菪碱、樟柳碱和N-去甲莨菪碱。《中国药典》以东莨菪碱为指标成分进行含量测定，要求东莨菪碱不得少于0.15%。莨菪烷类生物碱都是氨基醇的酯类，易水解，尤其在碱性水溶液中更易水解。甲基伪麻黄碱（E错）为麻黄的主要化学成分，属于有机胺类生物碱。麻黄中含有多种生物碱，以麻黄碱和伪麻黄碱为主，前者占总生物碱的40%～90%，《中国药典》以盐酸麻黄碱和盐酸伪麻黄碱为指标成分进行含量测定，要求药材和饮片含盐酸麻黄碱和盐酸伪麻黄碱的总量不得少于0.80%。此外麻黄还含少量的甲基麻黄碱、甲基伪麻黄碱和去甲基麻黄碱、去甲基伪麻黄碱。